经产妇，临产16小时，破膜18小时。宫缩强，下腹压痛，枕左前位，先露高，胎心150次/分，宫口开大2cm，胎头双顶径9.6cm，导尿见肉眼血尿。最可能的诊断是
A. 子宫破裂
B. 先兆子宫破裂
C. 胎盘早剥
D. 忽略性肩先露
E. 脐带脱垂

正确答案：B。先兆子宫破裂

解析：经产妇，宫口开大2cm，但已临产16小时，正常经产妇第一产程宫口开全（10cm）（潜伏期是指从开始规律宫缩至扩张2cm，需8小时），枕左前位，先露高，胎头双顶径9.6cm（正常约9.3cm）（可能出现胎头不能入盆，发生梗阻性难产），故为产程长、有梗阻性难产因素的产妇，有下腹压痛、肉眼血尿的症状，可考虑诊断为先兆子宫破裂（B对）。子宫破裂（A错）的产妇表现为突然的下腹撕裂样剧痛，之后可为持续性腹痛伴低血容量休克的征象。胎盘早剥（C错）有妊娠期高血压疾病史或外伤史，出现子宫呈板状硬、胎位不清、胎心常听不清。本例为枕左前位，不可能为忽略性肩先露（D错）。脐带脱垂（E错）的产妇，脐带降至阴道内甚至露于外阴部且会出现胎儿窘迫的征象。